成人阑尾切除术后1天出现烦躁、剧烈腹痛，心率112次/分，血压90/60mmHg，腹胀全腹压痛，肠鸣音弱。为除外腹腔内出血首要的检查是
A. B超
B. CT
C. MRI
D. 腹腔穿刺
E. 立位腹平片

正确答案：D。腹腔穿刺

解析：阑尾切除术后并发症包括：出血，切口感染，粘连性肠梗阻，阑尾残株炎，粪痿。患者术后1天出现腹痛，全腹压痛，心率快，血压下降，故为除外腹腔内出血，而腹腔穿刺为最简便可行的检查（D对）。